搽剂是指
A. 清洗阴道、尿道的液体制剂
B. 用于咽喉、口腔清洗的液体制剂
C. 专供涂抹、敷于皮肤的外用液体制剂
D. 专供揉搽皮肤表面用的液体制剂
E. 用纱布、棉花蘸取后涂搽皮肤或口、喉部黏膜的液体制剂

正确答案：D。专供揉搽皮肤表面用的液体制剂

解析：本题考查搽剂。搽剂系指原料药物用乙醇、油或适宜的溶剂制成的溶液、乳状液或混悬液，供无破损皮肤揉擦用的液体制剂（D对）；灌洗剂分护理保健类洗液和阴道灌洗清洁液两类（A错）；含漱剂系指用于咽喉、口腔清洗的液体制剂（B错）；洗剂系指含原料药物的溶液、乳状液、混悬液，供清洗或涂抹无破损皮肤或腔道用的液体制剂（C错）；涂剂系指涂于局部皮肤的外用澄清液体制剂（E错）。